心理治疗对心理治疗师的要求不包括
A. 要有一颗帮助别人的心
B. 要有一个敏锐的观察力
C. 要有丰富的生活经验和知识
D. 要具备乐观的生活态度
E. 要有高深的技能

正确答案：E。要有高深的技能